十二指肠溃疡的病理最不可能见到的是
A. 白细胞
B. 肉芽组织
C. 坏死组织
D. 陈旧性瘢痕组织
E. 异型细胞

正确答案：E。异型细胞

解析：十二指肠溃疡部位会有炎性细胞的渗出（A对），以及进行自我修复产生肉芽组织（B对），肉芽组织成熟后，会出现瘢痕组织（D对）。当然也有可能产生不可逆性的损伤，出现坏死（C对）。十二指肠癌变几率很小，可视作不癌变（E错，为本题正确答案）。